长期服用不仅使感染扩散，且诱发溃疡病出血的药物是
A. 氯氮䓬（利眠宁）
B. 苯海索（安坦）
C. 呋塞米（速尿）
D. 泼尼松（强的松）
E. 溴丙胺太林（普鲁本辛）

正确答案：D。泼尼松（强的松）

解析：本题考查药物的不良反应。长期服用不仅使感染扩散，且诱发溃疡病出血的药物是泼尼松（强的松）（D对）。泼尼松（强的松）属于糖皮质激素，糖皮质激素长期大量应用引起的不良反应有皮质功能亢进综合征、诱发或加重感染、诱发或加重溃疡病、诱发高血压和动脉硬化等。氯氮䓬（A错）可引起神经系统抑制，长期应用使老年人出现抑郁症。苯海索（B错）不良反应有口干、便秘、尿潴留、瞳孔散大、视力模糊等。呋塞米（C错）不良反应有体位性低血压、休克、低钾血症、低氯血症、低氯性碱中毒、低钠血症等。溴丙胺太林（E错）不良反应有口干、面红、视力模糊、尿潴留、便秘、头痛、心悸等。